女，4个月。双胎之小，单纯母乳喂养，面色苍白，食欲减退2个月。查体：肤色苍白，肝肋下3.5厘米，脾肋下1.5厘米。血Hb80g/L，RBC3.3×10¹²/L，MCV60fl，MCH24pg，MCHC25%，Plt、WBC正常。最可能的诊断是
A. 再生障碍性贫血
B. 营养性巨幼细胞贫血
C. 感染性贫血
D. 混合性贫血
E. 缺铁性贫血

正确答案：E。缺铁性贫血

解析：4个月女婴，双胎之小（缺铁性贫血多见年龄），单纯母乳喂养（缺铁性贫血诱因），近两个月面色苍白、食欲减退（缺铁性贫血一般表现），肝肋下3.5cm，脾肋下1.5cm（髓外造血表现），Hb80g/L（正常值大于110g/L），RBC3.3×10¹²/L（正常值4×10¹²/L），WBC、PLT正常，血象MCV60fl，MCH24pg，MCHC25%（小细胞低色素性贫血），根据患者的临床表现和实验室检查，应考虑的诊断是缺铁性贫血（E对）。婴儿期体格生长十分迅速，需大量各种营养素满足其生长，但婴儿的消化功能尚未成熟，如果加辅食不当易发生消化紊乱和营养不良等疾病很容易发生缺铁性贫血。再生障碍性贫血（A错）表现为发热、贫血和出血，肝、脾、淋巴结不肿大，血象呈全血细胞减少，骨髓有核细胞增生低下，无幼稚白细胞增生。营养性巨幼红细胞贫血（P359）（B错）主要是由于维生素B₁₂和（或）叶酸缺乏所致的一种大细胞性贫血，其临床突出表现为患儿有神经精神症状，如烦躁不安、易怒、表情呆滞、目光发直等，外周血象结果呈大细胞性贫血面色苍黄，且伴有智力低下。感染性贫血（C错）有前驱感染症状（细菌、病毒、各种急慢性感染），在引起炎症或感染的过程中使红细胞生成减少，破坏增加，可表现为急性溶血性贫血和慢性贫血。混合性贫血（七版诸福棠实用儿科学P1725）（D错）兼有大小细胞贫血的特点，是由于饮食中同时缺乏铁和维生素B₁₂或叶酸等造血物质所致。